灵芝孢子破壁粉碎宜采用
A. 串油粉碎法
B. 串料粉碎法
C. 水飞粉碎法
D. 加液研磨法
E. 超微粉碎法

正确答案：E。超微粉碎法